甲药品生产企业经批准可以生产第二类精神药品（口服剂型）、生物制品（注射剂），心血管类药品（注射剂和片剂），中药注射液和中药提取物的部分品种，乙药品生产企业持有与甲药品生产企业相同品种的《药品GMP》证书。甲药品生产企业可以委托乙药品生产企业生产药品的情形是
A. 甲药品生产企业生产线出现故障不再具有生产能力
B. 甲药品生产企业的某药品部分生产工序过于复杂，希望该部分生产工序委托生产的
C. 甲药品生产企业能力不足暂不能保障市场供应的
D. 甲药品生产企业被药品监督管理部门处以停产整顿处罚的

正确答案：C。甲药品生产企业能力不足暂不能保障市场供应的

解析：本题考查药品委托生产。药品委托生产，是指药品生产企业在因技术改造暂不具备生产条件和能力或产能不足暂不能保障市场供应的情况下（C对），将其持有药品批准文号的药品委托其他药品生产企业全部生产的行为，不包括部分工序的委托加工行为。